不属于地塞米松药理作用的是
A. 刺激骨髓造血功能
B. 抑制毛细血管和成纤维细胞增生
C. 增强机体对细菌内毒素的耐受力
D. 抑制体内环氧化酶
E. 稳定溶酶体膜

正确答案：D。抑制体内环氧化酶

解析：地塞米松药理作用：1.对代谢的影响；2.抗炎作用；3.免疫和抗过敏作用；4.抗休克作用；5.其他作用，如糖皮质激素能刺激骨髓的造血功能（A对）。其中抗炎作用包括在炎症早期，能减轻渗出和水肿，改善红、肿、热、痛等症状；炎症后期，糖皮质激素可以抑制毛细血管和成纤维细胞的增生（B对）。具体表现为：（1）对炎症抑制蛋白及某些靶酶的影响；①诱导脂皮素–1的生成；②抑制诱导型NO合成酶和环氧化酶2（D对）（COX–2）等的表达。（2）对细胞因子及黏附分子的影响。（3）对炎细胞凋亡的影响。（4）非基因组效应。抗休克作用机制包括：①抑制某些炎症分子的产生；②稳定溶酶体膜（E对）；③扩张痉挛收缩的血管和兴奋心脏；④提高机体对细菌内毒素的耐受力（C对）。本题无正确答案，原答案为D。